患儿10岁，上前牙牙龈时常流脓1月余。查左上1远中舌面深龋，探无反应，无穿髓孔，松I度，叩痛（+），冷热测无反应，唇侧牙龈近根尖处有一窦道口。为确定诊断，临床需做的检查是
A. 电活力测试
B. 穿刺
C. 局部麻醉
D. X线片
E. 涂片

正确答案：D。X线片

解析：本题考查慢性根尖周炎的诊断要点。患儿左上1远中舌面深龋，探诊无反应，牙髓活力测试无反应（A错），轻微松动，轻度叩痛，有窦道开口，据此怀疑为慢性根尖周炎，而X线片上根尖区骨质破坏的影像是确诊慢性根尖周炎的关键依据，因此，临床上需做X线片检查（D对）。穿刺（B错）与涂片（E错）一般用于软组织病变，穿刺获得一小部分组织，涂片观察组织在细胞层面上是否有病理学改变，操作困难，且不适用。局部麻醉（C错）主要用于当无法判断疼痛患牙，且两颗牙分别位于上、下颌或两颗牙均在上颌但不相邻时，判断引起疼痛的患牙，而上述病例仅一颗患牙，并不符合选择性麻醉的适用条件。